可分泌到乳汁中导致婴儿引起肝毒性，哺乳期妇女禁用的药品是
A. 谷氨酸钠
B. 头孢呋辛酯
C. 米诺环素
D. 麦角新碱
E. 阿莫西林

正确答案：C。米诺环素

解析：本题考查哺乳期妇女用药。可分泌到乳汁中导致婴儿引起肝毒性，哺乳期妇女禁用的药品是米诺环素（C对）。大剂量或长期使用四环素类如米诺环素、四环素均可能发生肝毒性，故哺乳期妇女应禁用米诺环素。头孢菌素类（B错）在乳汁中含量甚微，但第四代头孢菌素类如头孢匹罗、头孢吡肟例外。青霉素类如阿莫西林（E错）对乳儿安全。